有关胆道蛔虫症的临床表现，错误的是
A. 呕吐蛔虫史
B. 疼痛呈间歇性发作
C. 伴恶心呕吐
D. 发病12～24小时前出现较明显黄疸
E. 严重时可出现急性胆管炎

正确答案：D。发病12～24小时前出现较明显黄疸

解析：胆道蛔虫症指蛔虫窜入胆道引起的一系列临床症状。胆道蛔虫症多无黄疸，即使有黄疸出现，也只是轻度黄疸，发病12～24小时前不会出现较明显黄疸（D错，为本题正确答案）。呕吐蛔虫史（A对）、疼痛呈间歇发作（B对）、恶心呕吐（C对）都是胆道蛔虫症的临床表现。胆道蛔虫症若合并胆道感染，严重时可出现急性胆管炎（E对）。